某小学1年级学生，老师总是提醒他上课要“坐直，手背后”。2周下来，他已经能认真听讲了。这是因为大脑皮层出现了
A. 始动调节
B. 动力定型
C. 优势法则
D. 保护性抑制
E. 镶嵌式活动

正确答案：B。动力定型